患者，男，49岁。口中时时泛酸，兼见胃脘胀痛，矢气频作，泻下酸腐臭秽，舌苔厚腻，脉滑，此属
A. 肝胃不和证
B. 肝脾不调证
C. 胃热炽盛证
D. 食滞胃脘证
E. 胃阴不足证

正确答案：D。食滞胃脘证

解析：患者以口中泛酸，胃脘胀痛为主诉，可判断病位在胃；食积胃脘，胃失和降，气机不畅，故胃脘胀满疼痛、拒按；胃失和降，胃气上逆，胃气夹积食、浊气上逆，则嗳腐吞酸，或呕吐酸馊食物；吐后胃气暂得通畅，故胀痛得减；若积食下移肠道，阻塞气机，则腹胀腹痛，泻下不爽，肠鸣，矢气多而臭如败卵；腐败食物下注，泻下之物酸腐臭秽；胃中腐浊之气上蒸，舌苔厚腻；脉滑，为食积之象，故诊断患者为食滞胃脘证（D对）。肝胃不和证，临床表现为胃脘胁肋胀痛或窜痛，胃脘痞满，呃逆，嗳气，吞酸嘈杂，饮食减少，情绪抑郁，善太息，或烦躁易怒，舌淡红，苔薄白或薄黄，脉弦（A错）。肝脾不调证指肝失疏泄，脾失健运，以胁肋作痛、情志抑郁、腹胀、便溏等为主要表现的证候（B错）。胃热炽盛证，临床表现为胃脘灼痛、拒按，消谷善饥，口气臭秽，齿龈红肿疼痛，甚则化脓、溃烂，或见齿衄，渴喜冷饮，大便秘结，小便短黄，舌红苔黄，脉滑数（C错）。胃阴亏虚证，临床表现为胃脘隐隐灼痛，嘈杂不舒，饥不欲食，干呕，呃逆，口燥咽干，大便干结，小便短少，舌红少苔，脉细数（E错）。